味觉冲动传入至
A. 三叉神经脑桥核
B. 三叉神经脊束核
C. 孤束核全部
D. 孤束核上部
E. 孤束核下部

正确答案：D。孤束核上部

解析：味觉冲动经味觉初级纤维传入至孤束核上部（D对）。孤束核下部（E错）接受经舌咽神经和迷走神经传入的一般内脏感觉初级纤维。三叉神经脑桥核（A错）接受经三叉神经传入的头面部触、压觉初级纤维。三叉神经脊束核（B错）接受经三叉神经传入的头面部痛、温觉初级感觉纤维。